调节性T细胞的表型是
A. CD3⁺，CD4⁺，Foxp3⁻
B. CD3⁺，CD8⁺，Foxp3⁺
C. CD4⁺，CD25⁺，Foxp3⁺
D. CD20⁺，CD40⁺，Foxp3⁻
E. CD56⁺，CD94⁺，Foxp3⁻

正确答案：C。CD4⁺，CD25⁺，Foxp3⁺